男婴，3天。2天前出现皮肤黄染，逐渐加重，1天来嗜睡拒奶。查体：反应差，皮肤重度黄染，心肺未见异常，肝肋下3cm，肌张力低下。血RBC3.9×10¹²/L，Hb120g/L，网织红细胞0.09，血清总胆红素359μmol/L。最可能的诊断是
A. 新生儿缺氧缺血性脑病
B. 新生儿肝炎
C. 新生儿溶血病
D. 新生儿败血症
E. 新生儿化脓性脑膜炎

正确答案：C。新生儿溶血病

解析：男婴患者，2天前出现皮肤黄染（黄疸），逐渐加重，1天来嗜睡拒奶。查体：反应差，皮肤重度黄染，心肺未见异常，肝肋下3cm（肝大），肌张力低下。血RBC3.9×10¹²/L（正常值6.0～7.0×10¹²/L），Hb120g/L（正常值170～200g/L），网织红细胞0.09（正常值0.02～0.06），血清总胆红素359μmol/L（正常值1.71～17.1μmol/L）。该患者表现为黄疸、贫血、肝脾大，综合患者的症状、体征和辅助检查，最可能的诊断是新生儿溶血病（C对）。新生儿缺氧缺血性脑病（A错）无黄疸表现。新生儿肝炎（B错）起病缓慢，多无网织红细胞增多的表现。新生儿败血症（D错）血培养或无菌体腔液培养可见致病菌。新生儿化脓性脑膜炎（E错）表现为神志异常、眼部异常、惊厥、颅内压增高。